女，30岁。肛门周围胀痛，伴畏寒发热3天。检查：肛门周围皮肤发红，压痛明显。最可能的诊断是
A. 肛门旁皮下脓肿
B. 肛瘘炎
C. 混合痔
D. 内痔
E. 肛瘘

正确答案：A。肛门旁皮下脓肿

解析：患者肛周胀痛、皮肤发红、有压痛（属于局部炎症），是肛周脓肿典型表现，最可能的诊断是肛门旁皮下脓肿（A对）。肛窦炎（B错）的红肿疼痛表现在肛窦，而非肛周。患者未见肛门出血与脱出，应排除混合痔（C错）、内痔（D错）。患者无肛周瘘管，无分泌物，排除肛瘘（E错）。